稽留热最常见的疾病是
A. 肺结核
B. 大叶性肺炎
C. 急性肾盂肾炎
D. 疟疾
E. 胸膜炎

正确答案：B。大叶性肺炎

解析：稽留热常见于大叶性肺炎（B对）、斑疹伤寒及伤寒高热期。肺结核（A错）常见热型为弛张热和不规则热。急性肾盂肾炎（C错）和疟疾（D错）常见热型为间歇热。胸膜炎（E错）常见热型为不规则热。